下腔静脉的直接属支不包括
A. 肾静脉
B. 肝静脉
C. 肝门静脉
D. 腰静脉
E. 髂总静脉

正确答案：C。肝门静脉

解析：肾静脉（A对）、肝静脉（B对）、腰静脉（D对）、髂总静脉（E对）均为下腔静脉的直接属支。肝门静脉（C错，为本题正确答案）不是下腔静脉的直接属支。